治疗三叉神经痛的首选药为
A. 氯硝西泮
B. 苯妥英钠
C. 卡马西平
D. 山莨菪碱
E. 七叶莲

正确答案：C。卡马西平

解析：本题考查三叉神经痛的药物治疗。治疗三叉神经痛的首选药为卡马西平（C对）。对原发性三叉神经痛均应首先采用药物治疗：1.卡马西平：又称酰胺咪嗪、痛痉宁得理多、叉颠宁为抗癫痫药物，是目前治疗三叉神经痛的首选药物。此药抗惊厥机制不完全清楚，可能是增强钠通道灭活效能，限制突触后神经元和阻断突触前钠通道，稳定高度兴奋的神经细胞膜。2.奥卡西平：又称确乐多、卡西平、曲莱，此药为卡马西平的10-酮基结构类似物，在体内大部分被代谢为有活性的10-羟基代谢物。药理和临床作用与卡马西平相同，但易于耐受。3.苯妥英钠（B错）：又称大仑丁，也是一种抗癫痫药物，对多数病例有一定疗效。其作用机制为：对小脑有兴奋作用，可以激活小脑和大脑皮质的抑制通路。4.氯硝西泮（A错）：又称氯硝安定、利福全、静康等。5.七叶莲（E错）或野木瓜片：是中成药，用于治疗三叉神经痛。